血管神经性水肿一般不发生在
A. 唇
B. 上腭
C. 下颌下
D. 口底
E. 眼睑

正确答案：B。上腭

解析：本题考查血管神经性水肿。血管神经性水肿一般不发生在上腭（B错）。血管神经性水肿好发于头面部疏松区，唇（A对）、眼睑（E对）、舌、口底（D对）和下颌下（C对）。唇部损害可单独累及上唇或下唇，也可同时累及双唇。